下列为抗脂解激素的是
A. 胰高血糖素
B. 肾上腺素
C. 促肾上腺皮质激素
D. 甲状腺素
E. 胰岛素

正确答案：E。胰岛素

解析：脂肪细胞中储存的甘油三酯经一系列脂肪酶依次催化，逐步水解释出甘油和游离脂肪酸，运送到全身各组织利用，此过程称为脂肪动员。在脂肪动员过程中，胰岛素、前列腺素可以抑制其活性，称为抗脂解激素。掌握“脂肪的分解代谢”知识点。